欲对有200个数据的定量资料编制频数分布表描述其分布特征，在分组时，其组段数宜选择
A. 4～6
B. 8～15
C. 30～50
D. 51～60
E. 61～70

正确答案：B。8～15

解析：通常情况下组数选择在8～15之间（B对），以能显示数据的分布规律为宜。确定组数进行数据分组时首先应考虑组数，分组过少会导致信息损失较大：分组过多则可能使数据分布的规律性不能明显地表示出来。